若测得某物质的肾清除率为80ml/min，则可认为肾小管对该物质
A. 能否重吸收和分泌都不能确定
B. 必定能分泌，但不确定能否重吸收
C. 必定能重吸收，但不能确定能否分泌
D. 必定不能重吸收，也必定不能分泌
E. 必定能重吸收，也必定能分泌

正确答案：C。必定能重吸收，但不能确定能否分泌